患者，女，55岁，因“反复发作，胸骨后疼痛2年，伴反酸、胃灼热。诊断为积食”就诊。食管测压提示食管下括约肌（LES）压力<6mmHg，结合胃镜检查结果，临床诊断为胃食管反流病。医师处方奥美拉唑肠溶片20mg，bid强化抑酸治疗。关于奥美拉唑肠溶片用药教育的说话，错误的是
A. 适宜餐前30分钟服用
B. 应整片吞服
C. 用药后可能出现口干、便秘等不良反应
D. 长期用药后可能会出现维生素K缺乏
E. 长期用药后可能会出现骨质疏松

正确答案：D。长期用药后可能会出现维生素K缺乏

解析：本题考查奥美拉唑的使用。质子泵抑制剂奥美拉唑长期服用时，可导致维生素B₁₂和维生素C（D错，为本题正确答案）吸收下降。其用法是qd～bid，餐前30min（A对）。长期服用影响钙吸收，可致骨质疏松（E对）。可增加感染风险，便秘、口干（C对）。奥美拉唑肠溶片需整片服用（B对）。